药学人员在药学实践中，通过自我教育，不断改正缺点，体现了药学职业道德的
A. 激励作用
B. 促进作用
C. 调节作用
D. 约束作用
E. 督促和启迪作用

正确答案：B。促进作用